糖浆剂的质量要求有
A. 药用糖浆剂含蔗糖量应不低于45％（g/ml）
B. 相对密度、pH和乙醇含量符合规定要求
C. 在贮藏期间不得有酸败、异臭、产生气体等变质现象
D. 糖浆应澄清，贮藏期间允许有少量轻摇易散的沉淀
E. 装量差异限度均应符合规定要求

正确答案：A、C、D。药用糖浆剂含蔗糖量应不低于45％（g/ml）；在贮藏期间不得有酸败、异臭、产生气体等变质现象；糖浆应澄清，贮藏期间允许有少量轻摇易散的沉淀

解析：本题考查的是糖浆剂的质量要求。糖浆剂的质量要求有药用糖浆剂含蔗糖量应不低于45％（g/ml）（A对）、贮藏期间不得有酸败、异臭、产生气体等变质现象（C对）与糖浆应澄清，贮藏期间允许有少量轻摇易散的沉淀（D对）。糖浆剂系指含有原料药物的浓蔗糖水溶液。糖浆剂含蔗糖量应不低于45%（g/ml）。糖浆剂根据需要可加入适宜的附加剂，如需加入抑菌剂，除另有规定外，在制剂确定处方时，该处方的抑菌效力应符合《中国药典》抑菌效力检查法的规定，山梨酸和苯甲酸的用量不得过0.3%，羟苯酯的用量不得过0.05%。如需加入其他附加剂，其品种与用量应符合国家标准的有关规定，且不影响成品的稳定性，并应避免对检验产生干扰。必要时，可在糖浆剂中加入适量的乙醇、甘油或其他多元醇。糖浆剂应澄清，在贮存期间不得有发霉、酸败、产生气体或其他变质现象，允许有少量摇之易散的沉淀。应密封，避光置干燥处贮存。按照《中国药典》规定的方法检查，糖浆剂的pH、相对密度、装量及微生物限度等均应符合规定（BE错）。